可用于检识游离萘醌类化合物的显色反应有
A. Feigl反应
B. Liebermann-Burehard反应
C. Kestin9-Craven反应
D. Kedde反应
E. Molish反应

正确答案：A、C。Feigl反应；Kestin9-Craven反应